鼻旁窦的开口,下列说法正确的是
A. 上颌窦开口于上鼻道
B. 额窦开口于上鼻道的半月裂孔
C. 蝶窦开口于蝶筛隐窝
D. 前、中组筛窦开口于筛漏斗
E. 后组筛窦开口于中鼻道

正确答案：C。蝶窦开口于蝶筛隐窝

解析：蝶窦开口于蝶筛隐窝（C对）。上颌窦开口于中鼻道（A错）。额窦中鼻道（B错）。前、中组筛窦开口于中鼻道（D错）。后筛窦开口于上鼻道（E错）。